在零售药店必须有医师处方才能销售的是
A. 麻醉药品
B. 处方药
C. 甲类非处方药
D. 非处方药
E. 乙类非处方药

正确答案：B。处方药